广藿香与佩兰配伍，除能化湿和中外，又能
A. 清热，解表
B. 解暑，发表
C. 强筋，健骨
D. 调经，止血
E. 宣肺，止咳

正确答案：B。解暑，发表

解析：本题考查广藿香的配伍。广藿香与佩兰配伍，除能化湿和中外，又能解暑，发表（B对）。广藿香【配伍】广藿香配佩兰：广藿香微温，功能化湿和中、解暑、止呕，且兼发表；佩兰性平，功能化湿解暑。两药相配，尤善化湿和中、解暑、发表。凡湿浊中阻，无论兼寒兼热，也无论有无表证，均可投用。感冒清热颗粒【功能】疏风散寒，解表清热（A错）。仙茅【功效】补肾壮阳，强筋健骨（C错），祛寒除湿。鹿衔草【功效】祛风湿，强筋骨，调经止血（D错），补肺止咳。桑菊感冒片【功能】疏风清热，宣肺止咳（E错）。